一种生物对某种物质的摄入量大于其排出量，随着生物生命过程的延长，该物质在生物体内的含量逐渐增加，称为
A. 生物放大作用
B. 生物蓄积作用
C. 生物浓缩作用
D. 生物相互作用
E. 生物降解作用

正确答案：B。生物蓄积作用

解析：本题考查生物蓄积作用。一种生物对某种物质的摄入量大于其排出量，随着生物生命过程的延长，该物质在生物体内的含量逐渐增加，称为生物蓄积作用（B对ACDE错）。